《素问•五藏生成篇》说：“多食甘”，则
A. 肉胝陷而唇揭
B. 骨痛而发落
C. 筋急而爪枯
D. 脉凝泣而变色
E. 皮槁而毛拔

正确答案：B。骨痛而发落

解析：本题是对经典原文的考查。如果长期嗜好某种性味的食物，就会导致该脏的脏气偏盛，功能活动失调而发生多种病变。多食咸，则脉凝泣而变色（D错）；多食苦，则皮槁而毛拔（E错）；多食辛，则筋急而爪枯（C错）；多食酸，则肉胝皱而唇揭（A错）；多食甘，则骨痛而发落（B对）。记忆方法，不用逐字背诵，可选择关键词记忆，如多食咸，脉，多食苦，皮毛...